10月女婴，因面色不好就医，查Hb110g/L。为了明确该婴是否有体内贮铁减少，最重要的实验室检查是
A. 血清叶酸量测定
B. 血清铁测定
C. 总铁结合力测定
D. 铁蛋白测定
E. 转铁蛋白饱和度测定

正确答案：D。铁蛋白测定

解析：在正常的生理条件下，铁蛋白测定（D对）可以敏感的反映体内贮存铁量。血清叶酸量测定（A错）主要用于巨幼细胞贫血的临床检验。血清铁（SI）测定（B错）、总铁结合力（TIBC）测定（C错）和转铁蛋白饱和度（TS）测定（E错），这三项检查反映了血浆中的铁含量，通常在缺铁性贫血期（IDA期）才出现异常，即SI和TS降低TIBC升高。但这三者的生理变异大，感染、恶性肿瘤、类风湿性关节炎、病毒性肝炎等疾病对三者测定有明显影响，因而对体内贮存铁情况敏感度不及铁蛋白测定。